男，42岁，发热3天，咳嗽臭痰1天，胸部X线片示右下叶空洞影，其内有液平。治疗首选的是
A. 头孢唑啉
B. 左氧氟沙星
C. 庆大霉素
D. 克林霉素
E. 阿奇霉素

正确答案：D。克林霉素

解析：患者为中年男性，发热、咳脓臭痰（为肺脓肿的典型临床表现），胸部X线片可看到空洞影，有液平，根据其临床表现和辅助检查，考虑诊断为肺脓肿，常见的肺脓肿致病菌为厌氧菌，首选抗生素为青霉素，其次为克林霉素（D对）、林可霉素和甲硝唑。而阿奇霉素（E错）头孢唑啉（A错），左氧氟沙星（B错）对于厌氧菌的疗效不佳。庆大霉素（C错）属于氨基糖苷类有强烈的耳毒性，且厌氧菌常对氨基糖苷类抗生素有耐药性。